肛管内面的结构
A. 肛柱纵贯全长
B. 肛瓣位于相邻两肛柱下端之间
C. 肛窦是肛管最膨大的部分
D. 齿状线为肛柱上端的连线
E. 白线是肛管黏膜与皮肤的交界线

正确答案：B。肛瓣位于相邻两肛柱下端之间

解析：肛柱下端为肛瓣(A错)，肛瓣位于相邻两肛柱下端(B对)，肛窦为两肛柱下端之间向上开口的部分，深3-5mm(C错)，齿状线为肛柱下端与肛瓣边缘的连线(D错)，白线为肛梳下缘的环形线(E错)。